确诊口腔白斑病癌变的辅助检查是
A. 氢氧化钾涂片
B. PAS染色
C. 组织病理学检查
D. 脱落细胞检查
E. 甲苯胺蓝染色

正确答案：C。组织病理学检查

解析：本题考查口腔白斑的癌变预警。确诊口腔白斑病癌变的辅助检查是组织病理学检查（C对）。组织病理活检是目前诊断组织细胞癌变的金标准。10％氢氧化钾溶液涂片镜检可用于检测阴道念珠菌感染（A错）。PAS染色在组织学上，主要用来检测组织中的糖类，可用于口腔念珠菌病的检查（B错）。脱落细胞检查和甲苯胺蓝染色可辅助判断口腔白斑的癌变情况（DE错）。